可用碱提酸沉法提取，且属于黄酮类化合物的是
A. 白花前胡甲素
B. 莨菪碱
C. 苦杏仁苷
D. 柴胡皂苷a
E. 芦丁

正确答案：E。芦丁

解析：本题考查的是槐花中主要成分及其化学结构。可用碱提酸沉法提取，且属于黄酮类化合物的是芦丁（E对）。槐花中主要成分及其化学结构：槐米含有芦丁，槲皮素，皂苷，白桦脂醇，槐二醇以及槐米甲、乙、丙素和黏液质等。其中，芦丁是有效成分。槐米中芦丁的含量高达23.5%，槐花开放后降至13.0%。《中国药典》以总黄酮和芦丁为指标成分对槐米或槐花进行含量测定。要求槐花总黄酮（以芦丁计）不少于8.0%，槐米总黄酮不少于20.0%，对照品采用芦丁；要求芦丁含量，槐花不得少于6.0%，槐米不得少于15.0%。酸提碱沉法和碱提酸沉法：该法是利用酸碱性进行分离。对酸性、碱性或两性有机化合物来说，常可通过加入酸、碱以调节溶液的pH，改变分子的存在状态（游离型或解离型），从而改变溶解度而实现分离。例如，一些生物碱类在用酸性水从药材中提出后，加碱调至碱性即可从水中沉淀析出称为酸提碱沉法（酸／碱法）。提取黄酮、蒽醌类酚酸性成分时采用氢氧化钙提取，加酸中和使其沉淀出来达到分离的目的称为碱提酸沉法。白花前胡甲素（A错）为前胡的主要化学成分，属于香豆素。香豆素及其苷类化合物先溶解于热稀苛性碱的水溶液中，酸化后沉淀析出，借以和杂质分离从而达到提取和精制的目的。莨菪碱（B错）为洋金花的主要化学成分，属于生物碱。一些生物碱类在用酸性水从药材中提出后，加碱调至碱性即可从水中沉淀析出称为酸提碱沉法（酸／碱法）。苦杏仁苷（C错）为苦杏仁的主要化学成分，属于氰苷。苦杏仁苷易溶于水和醇，而几乎不溶于乙醚。根据此性质可采用萃取法提取苦杏仁苷。柴胡皂苷a（D错）为柴胡的主要化学成分，属于三萜皂苷。大多数皂苷极性较大，易溶于水、热甲醇和乙醇等极性较大的溶剂，难溶于丙酮、乙醚等有机溶剂。皂苷在含水正丁醇中有较大的溶解度，因此正丁醇常作为提取皂苷的溶剂。